太阳经证可见
A. 头顶痛
B. 偏头痛
C. 全头痛
D. 巅顶痛
E. 面额痛

正确答案：A。头顶痛

解析：太阳经证，见头顶痛（A对）；肝经风火上扰，见偏头痛（B错）；太阴、少阴头痛多以全头疼痛为主（C错）；厥阴头痛，多在巅顶部位，或连目系（D错）；阳明头痛，在前额部及眉棱骨处（E错）。